对洋地黄中毒后处理不正确的是
A. 补钾
B. 立即停药
C. 电复律
D. 阿托品
E. 应用抗心律失常药物

正确答案：C。电复律

解析：洋地黄药物易发生过量中毒反应，一旦发生应立即停药（B对），停用排钾利尿剂，对快速性心律失常者，如血钾浓度低则可用静脉补钾（A对）。洋地黄中毒最重要的表现是各类心律失常，应用抗心律失常药物（E对）治疗。电复律（C错，为本题正确答案）一般禁用，因易致心室颤动。有传导阻滞及缓慢性心律失常者可予阿托品（C错）静脉注射。